口腔流行病学分析性研究中常用的是
A. 病例对照研究
B. 横断面研究
C. 纵向研究
D. 常规资料研究
E. 现况调查

正确答案：A。病例对照研究

解析：本题考查分析性流行病学。它主要包括病例对照研究（A对）和群组研究。流行病学研究方法包括描述性研究、分析性研究、流行病学实验。横断面研究（B错）、纵向研究（C错）和常规资料分析（D错）属于描述性研究。流行病学研究方法之一的横断面调查也称现况调查（E错）。